男，36岁。反复咳嗽，咳痰4年。多于上呼吸道感染后发生，脓性痰，有时痰中带血，常伴发热。期间3次胸部X线片检查均为右下肺炎，经抗感染治疗可好转。本次上感后再次出现咳嗽，少量脓性痰。查体：右下肺可闻及中小水泡音。为明确诊断，宜首选的检查是
A. 查找癌细胞
B. 痰找抗酸杆菌
C. 胸部CT
D. 支气管镜
E. 痰培养＋药敏

正确答案：C。胸部CT

解析：患者青年男性，反复咳嗽，咳痰4年。多于上呼吸道感染后发生，脓性痰，有时痰中带血，常伴发热（支气管扩张典型临床表现）。期间3次胸部X线片检查均为右下肺炎，经抗感染治疗可好转。本次上感后再次出现咳嗽，少量脓性痰。查体：右下肺可闻及中小水泡音（气道或非内分泌物）。综合患者病史、症状及体征，考虑诊断为支气管扩张症，主要依靠胸部CT明确诊断（C对）。查找癌细胞（A错）适用于肺癌的检查。痰找抗酸杆菌（B错）为肺结核检查。支气管镜（D错）主要用于主支气管及大分支的器质性病变。痰培养＋药敏（E错）适用于判别不同种类的肺炎。